男，21岁。3天前受凉后“感冒”，症状已好转。1小时前参加篮球比赛后出现气促。查体：双肺散在哮鸣音，心率84次/分。该患者发病最可能的机制是
A. 肺血管阻力增加
B. 心力衰竭
C. 神经调节失衡
D. 气道高反应性
E. 气道重构

正确答案：D。气道高反应性

解析：患者在运动之后出现气促，双肺可闻及散在哮鸣音，考虑诊断为支气管哮喘。该患者支气管哮喘的发病机制最可能是因为受到运动刺激因子的作用而引发的气道高反应性（D对）。气道重构（E错）是哮喘的重要病理特征，见于哮喘长期反复发作的患者，可见到支气管平滑肌肥大/增生、气道上皮细胞黏液化生、上皮下胶原沉积和纤维化等表现。肺血管阻力增加（A错）常见于先天性心脏病患者（如：室间隔缺损），并且发作与运动无关。急性左心衰（P174-P175）（B错）导致的心源性哮喘患者一般为中老年患者（题干中为青年男性），临床表现为端坐呼吸，阵发性咳嗽，常咳出粉红色泡沫痰。神经因素是哮喘发病的重要环节之一，神经调节失衡（C错）常与自主神经功能紊乱、慢性气道炎症有关，参与气道高反应性的形成，是气道高反应性的发生机制之一。